慢性非传染性疾病的过早死亡与下列哪项有关
A. 生物因素
B. 治疗不当
C. 不良行为与不科学的生活方式
D. 卫生服务不好
E. 医疗技术落后

正确答案：C。不良行为与不科学的生活方式